男，28岁。上腹部不适、腹泻伴消瘦半年，无发热。近2年有静脉吸毒史。胃镜检查见食管上覆白膜，慢性浅表性胃炎。实验室检查：血WBC3.8×10⁹/L。最有助于明确诊断的检查是
A. 血糖
B. CD4⁺T细胞计数
C. 抗-HIV
D. 血免疫球蛋白水平
E. 血沉

正确答案：C。抗-HIV

解析：28岁男性患者，有静脉吸毒史（HIV易感高危人群），上腹部不适、腹泻伴消瘦半年，无发热（HIV相关症状），胃镜检查见食管上覆白膜（白色念珠菌食管炎），慢性浅表性胃炎（HIV相关消化道症状）；实验室检查：血WBC3.8×10⁹/L（成人正常参考值4～10×10⁹/L），最有助于明确诊断的检查是抗-HIV（C对），HIV-1/HIV-2抗体检测是HIV感染诊断的金标准。感染HIV后，患者可以出现CD4⁺T细胞计数（B错）和血免疫球蛋白水平（D错）的降低，但其特异性不高。HIV感染后可使血沉（E错）发生改变，但特异性较低。血糖（A错）主要用于糖尿病的诊断，而对于HIV无诊断意义，故应排除。